痛风患者摄入蛋白质应主要选择
A. 主食
B. 畜肉
C. 水产品
D. 牛奶、鸡蛋
E. 水

正确答案：D。牛奶、鸡蛋

解析：本题考查痛风患者摄入蛋白质的选择。痛风患者应限制蛋白质的摄入量从而控制嘌呤的摄取，主要选择牛奶、鸡蛋（D对ABCE错）。